乙型强心苷元的UV特征吸收波长范围是
A. 215-220nm
B. 225-240nm
C. 250-270nm
D. 265-285nm
E. 295-300nm

正确答案：E。295-300nm

解析：本题考查的是乙型强心苷的最大吸收峰。乙型强心苷元的UV特征吸收波长范围是295-300nm（E对）。具有Δαβ-γ-内酯环的甲型强心苷元在217～220nm（lgξ4.20～4.24）（A错）处呈现最大吸收，具有Δαβ、Δγδ-δ-内酯环的乙型强心苷元在295～300nm（lgξ3.93）处有特征吸收。借此可区分两类强心苷。